阳偏胜引起的病理变化是
A. 实寒证
B. 虚寒证
C. 虚热证
D. 实热证
E. 寒热错杂证

正确答案：D。实热证

解析：阳偏胜指机体在疾病过程中所出现的阳邪偏盛、功能亢奋、机体反应性增强而产生热象的病机变化，其病机特点为阳盛而阴未虚，临床表现以实热证为主（D对）。实寒证是阴偏胜所致，机体在疾病过程中出现的阴邪偏盛、功能抑制、机体反应性减弱而产生寒象的病机变化，临床表现为实寒症为主（A错）。虚寒证是阳偏衰的病理变化，阳偏衰，机体阳气虚损，温煦、推动、气化等功能减退，出现虚寒内生的病机变化，临床表现为虚寒证（B错）。虚热证是阴偏衰的病理变化，阴偏衰，机体阴液不足，凉润、宁静、抑制等功能减退、阴不制阳，出现虚热内生的病机变化，临床表现为虚热证（C错）。寒热错杂证是指机体同时出现寒证和热证，呈现寒热交错的现象，其病机是阴阳不相顺接，表里不相贯通，阳气不能外达四肢所致（E错）。